37岁妇女，因阴部有块物脱出就诊。妇科检查见部分宫体与宫颈外露于阴道口，宫颈较长。本例恰当处理应是
A. 阴道前后壁修补术
B. Manchester手术
C. 阴道纵隔形成术
D. 阴道子宫全切除及阴道前后壁修补术
E. 经腹子宫全切除术

正确答案：B。Manchester手术

解析：该患者为中年女性，因阴部有块物脱出就诊，妇检：部分宫体与宫颈外露于阴道口，宫颈较长（Ⅱ度轻型：宫颈脱出阴道口，宫体仍在阴道内；重型：宫颈及部分宫体脱出阴道口），诊断为Ⅱ度重型子宫脱垂，恰当处理应是进行Manchester手术（曼氏手术）（B对）。其包括阴道前后壁修补、主韧带缩短及宫颈部分切除术，适用于年龄较轻、宫颈较长的子宫脱垂患者。经阴道子宫全切除及阴道前后壁修补术（P289）（D错）、经腹子宫全切除术（E错）适用于年龄较大、无需考虑生育功能的患者。阴道前后壁修补术（P285）（A错）适用于只有阴道前后壁膨出的患者。阴道纵隔形成术（C错）仅适合于年老体弱不能接受较大手术，且无需保留性交功能者。